以久病咳嗽，呼多吸少，乏力少气，自汗耳鸣，腰膝酸软为特征的证候是
A. 肺肾气虚
B. 肺气虚
C. 脾肺气虚
D. 心肺气虚
E. 肾气不固

正确答案：A。肺肾气虚

解析：“肺肾气虚证，指肺肾气虚，摄纳无权，以久病咳喘、呼多吸少、动则尤甚与气虚症状为主要表现的证候，临床表现为咳嗽无力，呼多吸少，气短而喘，动则尤甚，吐痰清稀，声低，乏力，自汗，耳鸣，腰膝酸软，或尿随咳出，舌淡紫，脉弱，本证以久病咳喘、呼多吸少、动则尤甚与气虚症状共见为辨证的主要依据”，本题临床表现与之相符，结合辨证依据，肾为气之根，肺司呼吸，肾主纳气，肺气虚，呼吸功能减弱，则久病咳嗽；肾气虚，不主摄纳，气不归元，则呼多吸少；宗气不足，卫表不固，则乏力少气、自汗；耳窍失充，则耳鸣；腰膝失养，则腰膝酸软，故以久病咳嗽，呼多吸少，乏力少气，自汗耳鸣，腰膝酸软为特征的证候是肺肾气虚证（A对）。“肺气虚证，临床表现为咳嗽无力，气短而喘，动则尤甚，咯痰清稀，声低懒言，或有自汗、畏风，易于感冒，神疲体倦，面色淡白，舌淡苔白，脉弱”，本题临床表现与之不相符(B错)。“脾肺气虚证，临床表现为食欲不振，食少，腹胀，便溏，久咳不止，气短而喘，咯痰清稀，面部虚浮，下肢微肿，声低懒言，神疲乏力，面白无华，舌淡，苔白滑，脉弱”，本题临床表现与之不相符（C错）。“心肺气虚证，临床表现为胸闷，咳嗽，气短而喘，心悸，动则尤甚，吐痰清稀，神疲乏力，声低懒言，自汗，面色淡白，舌淡苔白，或唇舌淡紫，脉弱或结或代”，本题临床表现与之不相符（D错）。“肾气不固证，临床表现为腰膝酸软，神疲乏力，耳鸣失聪；小便频数而清，或尿后余沥不尽，或遗尿，或夜尿频多，或小便失禁；男子滑精、早泄；女子月经淋漓不尽，或带下清稀量多，或胎动易滑。舌淡，苔白，脉弱”，本题临床表现与之不相符（E错）。